当剩余牙槽嵴重度吸收时，常需要进行种植前
A. 骨增量手术
B. 骨移植手术
C. 牙槽骨重建术
D. 骨尖磨除术
E. 骨突磨损术

正确答案：A。骨增量手术

解析：全口义齿在行使功能过程中可能出现脱位，在下颌尤其常见。无论下颌剩余牙槽嵴的情况如何，采用种植覆盖全口义齿修复都能够明显改善无牙颌患者的义齿满意度。当患者剩余牙槽嵴没有或只有少量吸收时，可以采用全口义齿，种植覆盖义齿等各种设计方案，当采用种植覆盖义齿设计时，上部结构的选择应考虑颌间距离的限制。当剩余牙槽嵴中度吸收时，各种设计也都是可行的，通常种植覆盖义齿的设计有利于用基托恢复软硬组织的缺损。当剩余牙槽嵴重度吸收时，常需要进行种植前骨增量手术，再进行种植义齿的修复，或选用小直径种植体或短种植体。掌握“种植覆盖全口义齿”知识点。